副交感神经低级中枢与神经节间的纤维是
A. 节间支
B. 节前纤维
C. 节后纤维
D. 感觉纤维
E. 躯体运动纤维

正确答案：B。节前纤维

解析：副交感神经的低级中枢位于脑干的一般内脏运动核和脊髓骶部第2-4节段灰质的骶副交感核，由这些核的神经元发出的纤维即节前纤维（B对）。